按化学组成分类，血竭属于
A. 单树脂类
B. 胶树脂类
C. 油胶树脂类
D. 油树脂类
E. 香树脂类

正确答案：A。单树脂类

解析：本题考查的是树脂的化学组成和分类。按化学组成分类，血竭属于单树脂类（A对）。（1）单树脂类树脂中一般不含或很少含挥发油、树胶及游离芳香酸，通常又分为：①酸树脂：主成分为树脂酸，如松香。②酯树脂：主成分为树脂酯，如枫香脂、血竭。③混合树脂：无明显的主成分，如洋乳香。（2）胶树脂类（B错）主成分为树脂和树胶，如藤黄。（3）油胶树脂类（C错）主成分为树脂、挥发油和树胶，如乳香、没药、阿魏。（4）油树脂类（D错）主成分为树脂与挥发油，如松油脂、加拿大油树脂。（5）香树脂类（E错）主成分为树脂、游离芳香酸（香脂酸）、挥发油，如苏合香、安息香等。